细菌超抗原可引发
A. 球菌食物中毒
B. 梭杆菌食物中毒
C. 链球菌食物中毒
D. 毒性休克综合征
E. 乳杆菌食物中毒

正确答案：D。毒性休克综合征

解析：细菌超抗原可引发金葡菌食物中毒和毒性休克综合征。掌握“抗原基本概念、分类、超抗原及佐剂”知识点。